可通过减毒活疫苗能有效预防其感染的是
A. 轮状病毒
B. 脊髓灰质炎病毒
C. 埃可病毒
D. 萨科奇病毒
E. 肠道腺病毒

正确答案：B。脊髓灰质炎病毒

解析：本题考查脊髓灰质炎病毒的防治原则。可通过减毒活疫苗能有效预防其感染的是脊髓灰质炎病毒（B对）。轮状病毒（A错）的预防以控制传染源和切断传播途径为主，其中消毒污染物品和加强洗手环节都是重要措施；口服减毒活疫苗目前已进人临床试验阶段，该疫苗可刺激机体产生特异性抗体，取得了有效的保护效果，但安全性尚需进—步观察。埃可病毒（C错）、萨科奇病毒（D错）目前尚无有效的疫苗用于预防，也没有特效的治疗药物。肠道腺病毒（E错）目前尚无有效疫苗和特别的抗病毒治疗方法，主要采取对症治疗。